下列对发热病人的处理哪项不正确
A. 寻找病因，针对病因治疗
B. 对一般发热解热有利疾病康复
C. 注意水盐代谢，预防脱水
D. 补充维生素
E. 进食易消化营养物质

正确答案：B。对一般发热解热有利疾病康复

解析：对于发热病人的处理有以下几点：①寻找病因，针对病因治疗（A对）；②对于一般发热患者来说，可不急于解热（B错，为本题正确答案），主要应针对物质代谢的加强和大汗脱水等情况予以补充维生素（D对）和进食易消化营养物质（E对），最主要注意水盐代谢，预防脱水（C对）；③ 对于发热能够加重病情或促进疾病的发生发展或威胁生命的那些病例，应不失时机地及时解热。